男，6岁。发热腹泻1日，腹泻7～8次/天，粘液脓血便，腹痛伴里急后重，之前吃过未洗黄瓜。诊断为细菌性痢疾，其类型属于
A. 轻型
B. 普通型
C. 中毒型
D. 重型
E. 慢性型

正确答案：B。普通型

解析：慢性细菌性痢疾指病情迁延超过2个月，该患儿急性起病，属于急性细菌性痢疾（E错）。急性细菌性痢疾分为普通型、轻型、重型及中毒型。其中轻型（A错）中毒症状较轻，无脓血便，腹泻每日10次以下；重型（D错）有剧烈的全身中毒症状及肠道症状，病情进展快，易发生休克；中毒型（D错）全身中毒症状明显而肠道炎症反应轻，常有中枢神经系统症状。该患儿症状较为典型，属于普通型（B对）。